躯体前屈时腹痛明显，直立位时减轻，提示何种疾病
A. 十二指肠瘀滞症
B. 胰腺体部癌
C. 反流性食管炎
D. 胃黏膜炎
E. 胃溃疡

正确答案：C。反流性食管炎

解析：反流性食管炎（C对）患者烧灼痛在上体前屈时腹痛明显，直立位时减轻。胃粘膜炎（D错）和胃溃疡（E错）疼痛与体位关系不大。十二指肠瘀滞症（A错）患者膝胸卧位或俯卧位可使腹痛及呕吐等症状缓解。胰腺体部癌（B错）患者仰卧位时疼痛明显，而前倾位或俯卧位时减轻。